具有二氢叶酸还原酶抑制作用的药物是
A. 盐酸左旋咪唑
B. 吡喹酮
C. 乙胺嘧啶
D. 磷酸氯喹
E. 甲硝唑

正确答案：C。乙胺嘧啶

解析：本题考查乙胺嘧啶。具有二氢叶酸还原酶抑制作用的药物是乙胺嘧啶（C对）。乙胺嘧啶能抑制疟原虫的二氢叶酸还原酶，使其叶酸代谢受阻，从而影响疟原虫的核酸合成，使其生长繁殖受到抑制。盐酸左旋咪唑（A错）为广谱驱肠虫药。吡喹酮（B错）为抗血吸虫病药。磷酸氯喹（D错）为为4氨基喹啉类，对疟原虫红细胞内期裂殖体起作用，可能系干扰了疟原虫裂殖体DNA的复制与转录过程或阻碍了其内吞作用，从而使虫体由于缺乏氨基酸而死亡。甲硝唑（E错）为抗阿米巴病药。